玄参的主产地是
A. 云南
B. 浙江
C. 福建
D. 河南
E. 陕西

正确答案：B。浙江

解析：本题考查的是玄参的主产地。玄参的主产地是玄参（B对）。玄参：【产地】主产于浙江省，四川、湖北、江苏等省亦产。多为栽培品。主产云南（A错）的中药为云药。云药：主产地云南。如三七、木香、重楼、茯苓、萝芙木、诃子、草果、马钱子、儿茶等。主产福建（C错）的中药有泽泻、桑寄生、薏苡仁、青黛等。主产河南（D错）的中药为怀药。怀药：主产地河南。如著名的“四大怀药”——地黄、牛膝、山药、菊花；以及天花粉、瓜蒌、白芷、辛夷、红花、金银花、山茱萸等。主产陕西（E错）的中药有华细辛、藁本、茜草、淫羊藿、沙苑子、茵陈等。